属于按造成突发环境污染事件的物质分类的是
A. 易燃易爆危险品泄漏、爆炸事件
B. 生产过程中意外事故引发的泄漏、爆炸事件
C. 人为破坏引发的泄漏、爆炸事件
D. 运输过程中意外事故引发的泄漏、爆炸事件
E. 贮存过程中意外事故引发的泄漏、爆炸事件

正确答案：A。易燃易爆危险品泄漏、爆炸事件